食品法典委员会的缩写是
A. FDA
B. CAC
C. EPA
D. EFSA
E. JECFA

正确答案：B。CAC

解析：本题考查食品法典委员会的缩写。食品法典委员的英文名称为Codex Alimentarius Commission，缩写为CAC（B对ACDE错）。